下列哪种物质为终致癌物
A. 苯并（a）芘
B. AFB₁
C. 亚硝胺
D. 亚硝酰胺
E. 聚氯乙烯

正确答案：D。亚硝酰胺